有明显囊壳结构的是
A. 纳米粒
B. 微囊
C. 纳米乳
D. 微球
E. 脂质体

正确答案：B。微囊

解析：本题考查微囊。有明显囊壳结构的是微囊（B对）。微囊系指用天然的或合成的高分子材料（统称为囊材）作为囊膜壁壳，将固态或液态药物包裹成为的药库型微型胶囊。纳米粒（A错）系指药物与载体辅料经纳米化技术分散形成的粒径＜500nm的固体粒子。纳米乳（C错）系指将药物溶于脂肪油/植物油中经磷脂乳化分散于水相中形成50～100nm粒径的O/W型微粒载药分散体系。微球（D错）是使药物溶解/或分散在高分子材料基质中，形成骨架型（亦称基质型）微小球状实体。脂质体（E错）是将药物包封于类脂质双分子层形成的薄膜中间所得的超微型球状载体。